接种单位接种疫苗
A. 根据预防接种工作的需要，制定第一类疫苗的需求计划和第二类疫苗购买计划
B. 接种第二类疫苗可以收取服务费、接种耗材费
C. 应当遵守预防接种工作规范、免疫程序、疫苗使用指导原则和接种方案
D. 责任区内的预防接种工作，并接受所在地的县级疾病预防控制机构的技术指导
E. 及时向接种单位分发第一类疫苗

正确答案：C。应当遵守预防接种工作规范、免疫程序、疫苗使用指导原则和接种方案